实验设计的三个基本要素是
A. 受试对象、处理因素、实验效应
B. 受试对象、研究人员、处理因素
C. 受试对象、干预因素、处理因素
D. 处理因素、实验效应、实验场所
E. 处理因素、实验效应、研究人员

正确答案：A。受试对象、处理因素、实验效应